小檗碱为主要有效成分的是
A. 黄连
B. 黄柏
C. 两者均有
D. 两者均无

正确答案：C。两者均有

解析：本题考查的是原小檗碱类生物碱。小檗碱为主要有效成分的是黄连与黄柏（C对）。原小檗碱类：可以看成由两个异喹啉环稠合而成。依据两者结构母核中D环氧化程度不同，又分为小檗碱类和原小檗碱类。前者多为季胺碱，如黄连（A错）、黄柏（B错）、三颗针中的小檗碱；后者多为叔胺碱，如延胡索中的延胡索乙素。